牛奶制品中，不宜作为婴儿主食的是
A. 全脂奶粉
B. 蒸发乳
C. 酸奶
D. 甜炼乳
E. 配方奶粉

正确答案：D。甜炼乳

解析：使用牛奶制品进行人工喂养时应充分考虑牛奶制品的宏量营养素比例，尽量选择选择宏量营养素成分接近人乳的牛奶制品。全脂奶粉（A对）是将鲜牛奶浓缩、喷雾、干燥制成，按重量1：8（30g乳粉加240g水），或按体积1：4（1匙乳粉加4匙水）加开水冲调成乳汁，其成份与鲜牛奶相似，可作为婴儿主食。蒸发乳（B对）是鲜牛奶经蒸发浓缩至一半容量，高温消毒，装罐保存，加等量开水即成全脂牛奶。酸奶（C对）为鲜牛奶加乳酸杆菌发酵制成，其凝块细、酸度高，有利于消化吸收。甜炼乳是将鲜乳经真空浓缩或其他方法除去大部分的水分，浓缩至原体积25%～40%左右的乳制品，再加入40%的蔗糖装罐制成的，糖类含量过高，宏量营养素比例与人乳相差较远（D错，为本题正确答案）。配方奶粉（E对）是以牛乳为基础的改造奶制品，其宏量营养素成分最接近人乳，是人工喂养的首选配方奶粉。